配对资料符号秩和检验，若有两个差数的绝对值相等，符号相反，其前已排至第2秩次，则它们的秩次应编为
A. 3和4
B. 3.5和3.5
C. 3和（-4）
D. （-3）和4
E. （-3.5）和3.5

正确答案：E。（-3.5）和3.5